最常受到烷化的是鸟嘌呤的
A. N-5位
B. N-6位
C. N-7位
D. O-7位

正确答案：C。N-7位

解析：本题考查最常受到烷化的鸟嘌呤部位。最常发生烷化作用的是鸟嘌呤的N-7位（C对ABD错），其次是O-6位。